初孕妇，29岁，妊娠37周。头痛1周，今晨喷射性呕吐1次，1小时前突然抽搐并随即昏迷入院。查体：BP180/120mmHg。尿蛋白（+++）。该患者最可能的诊断是
A. 子痫
B. 脑出血
C. 癔症
D. 癫痫
E. 脑血栓形成

正确答案：A。子痫

解析：该初孕妇，29岁，妊娠37周，出现了喷射性呕吐（重度子痫前期可有持续头痛、喷射性呕吐或视觉障碍或其它脑神经症状，提示颅内高压），抽搐并随即昏迷入院，查体血压BP180/120mmHg（重度子痫前期收缩压≥160mmHg和（或）舒张压≥110mmHg），尿蛋白（+++）（重度子痫前期随机尿蛋白≥（+++）），子痫是在重度子痫前期基础上发生不能用其他原因解释的抽搐，昏迷，故最可能的诊断是子痫（A对）。脑出血（B错）可为子痫的严重并发症，出现突然昏迷，意识丧失，查体：软性偏瘫，病理反射阳性，瞳孔多不对称。脑血栓形成（E错）一般多见于中老年人，昏迷前无抽搐，醒来后常出现不同程度的偏瘫。癔症（C错）常有精神诱发因素，属于精神病范畴，主要表现为各种躯体症状，意识范围缩小，选择性遗忘或精神暴发等精神症状；癫痫（D错）多有发作史，发作前常有先兆，发作时间短，继之神智丧失，跌倒，全身痉挛，大小便失禁，但抽搐后多数立即清醒，两者均无高血压、水肿及蛋白尿。